霍乱的粪便性状是
A. 米泔样
B. 黏液脓样
C. 柏油样
D. 灰白色
E. 果酱样

正确答案：A。米泔样

解析：霍乱的粪便性状是黄色水样或米泔样（A对）。黏液脓样（人卫八版传染病学P180）（B错）为细菌性痢疾的粪便性状，柏油样（C错）为上消化道出血的粪便性状，灰白色（D错）为梗阻性黄疸的粪便性状，果酱样（人卫八版传染病学P273）（E错）为阿米巴痢疾的粪便性状。